男，55岁。一周来感觉右手和右脚麻木，心烦意乱，但生活工作仍能进行。心理治疗可以选择的心理测试是
A. EPQ问卷
B. 16PF问卷
C. MMPI调查表
D. H-R成套测验
E. IAI测验

正确答案：A。EPQ问卷

解析：艾森克人格问卷（EPQ）（A对）为自陈量表，反映患者的人格特征，多用于某些心理障碍病人的诊断和病情预后的参考，实施方便，是我国临床应用最为广泛的人格测验。本题的患者已经有心烦意乱、手脚麻木的症状，应使用EPQ进行诊断，以进行下一步治疗。EPQ由三个人格维度量表和一个效度量表组成：（1）神经质维度：测查情绪稳定性。高分反映易焦虑、抑郁和较强烈的情绪反应倾向等特征。举例：你容易激动吗？（2）内-外向（E）维度：测查内向和外向人格特征。高分反映个性外向，具有好交际、热情、冲动等特征，低分则反映个性内向，具有好静、稳重、不善言谈等特征。 举例：你是否健谈？（3）精神质（P）维度：测查一些与精神病理有关的人格特征。高分可能具有孤独、缺乏同情心、不关心他人、难以适应外部环境、好攻击、与别人不友好等特征：也可能具有极其与众不同的人格特征。举例：你是否在晚上小心翼翼地关好门窗？（4）掩饰（L）量表：测查朴实、遵从社会习俗及道德规范等特征。在国外，高分表明掩饰、隐瞒，但在我国L分高的意义仍未十分明了。卡特尔 16 项人格因素问卷（16PF）（B错）是采用主成分分析方法编制而成的量表，16个根源特质是构成人格的内在基础因素，主要用于科研或心理咨询时对人格的评价等，测量这些特质即可知道个体的人格，辅助诊断的参考性和实施的便捷性不及EPQ。尼苏达多项人格测试（MMPI）反映个体的一般性认知特点（C错）。H-L成套测验（D错）是神经心理学测验，主要包括一些个别能力测验，如感知运动测验、记忆测验、联想思维测验等。